前置胎盘错误的是
A. 孕28周后胎盘附着于子宫下段
B. 甚至胎盘下缘达到宫颈内口
C. 其位置低于胎先露部
D. 孕24周后胎盘附着于子宫前部
E. 覆盖宫颈内口

正确答案：D。孕24周后胎盘附着于子宫前部

解析：前置胎盘是指妊娠28周后（D错，为本题正确答案），胎盘附着于子宫下段（A对），甚至胎盘下缘达到或覆盖宫颈内口（BE对），其位置低于胎先露部（C对），前置胎盘是妊娠期严重的并发症，是妊娠晚期阴道流血的主要原因。